患者，女，45岁。一年前临床诊断为室上性心动过速，服用美托洛尔片25mgbid近日因反复胃痛就诊，胃镜检查诊断为胃溃疡，幽门螺杆菌阳性，医师处方：埃索美拉唑镁肠溶片20mgbid，甲硝唑片04gbid，克拉霉素片5Omgbid，枸橼酸铋钾胶囊0.6gbid。该处方中，给药剂量错误的药物是
A. 埃索美拉唑镁肠溶片
B. 克拉霉素片
C. 甲硝唑片
D. 枸橼酸铋钾胶囊
E. 美托洛尔片

正确答案：B。克拉霉素片

解析：本题考查药物的使用。根除幽门螺杆菌感染的方案四联疗法，根除率较高，可应用PPI+克拉霉素+阿莫西林+铋剂，7～14d或PPI+克拉霉素+甲硝唑+铋剂，7～14d。埃索美拉唑20mg bid，餐前 30min（A对）、枸橼酸铋钾0.6g bid ，餐前 30min（D对）、甲硝唑0.4g bid（C对），餐后 30min、克拉霉素500mg bid ，餐后30min（B错，为本题正确答案）。